双酚A-甲基丙烯酸缩水甘油酯是
A. 窝沟封闭剂稀释剂
B. 窝沟封闭剂可见光固化引发剂
C. 窝沟封闭剂所配酸蚀剂
D. 窝沟封闭剂自凝固化引发剂
E. 窝沟封闭剂树脂基质

正确答案：E。窝沟封闭剂树脂基质

解析：本题考查窝沟封闭剂的组成。双酚A-甲基丙烯酸缩水甘油酯是窝沟封闭剂树脂基质（E对）。窝沟封闭剂稀释剂一般有甲基丙烯酸酯、二缩三乙二醇双甲基丙烯酸酯，甲基丙烯酸缩水甘油酯等（A错）。窝沟封闭剂可见光固化引发剂可分为自凝引发剂与光固化引发剂，前者常由过氧化苯甲酰（BPO）和芳香胺，如 N-N二羟乙基对甲苯胺（DHPT）组成（D错）；光固引发剂中，紫外光固化引发剂用安息香醚类，可见光固化引发剂采用α-二酮类光敏剂，如樟脑酯（B错）。窝沟封闭酸蚀剂为磷酸液或磷酸凝胶（C错）。